环境卫生学研究的自然环境包括哪四部分
A. 大气圈、水圈、岩石圈、食物圈
B. 大气圈、水圈、岩石圈、生物圈
C. 大气圈、水圈、有机圈、无机圈
D. 大气圈、水圈、土壤圈、食物圈
E. 生产圈、消费圈、分解圈、非生命圈

正确答案：B。大气圈、水圈、岩石圈、生物圈

解析：本题考查环境卫生学研究的自然环境。环境卫生学研究的自然环境包括大气圈、水圈、土壤岩石圈和生物圈（B对ACDE错）四部分。